当研究对象考虑到自身的利益关系（如隐私问题）时，为研究者提供虚假的信息，造成的偏倚为
A. 回忆偏倚
B. 报告偏倚
C. 测量偏倚
D. 暴露怀疑偏倚

正确答案：B。报告偏倚

解析：本题考查报告偏倚。当研究对象考虑到自身的利益关系（如隐私问题）时，为研究者提供虚假的信息，造成的偏倚为报告偏倚（B对ACD错）。报告偏倚是指询问调查对象有关问题时，由于种种原因回答不准确而造成的偏倚。